有关药物吸收的错误描述是
A. 舌下或直肠给药吸收少，起效慢
B. 药物从胃肠道吸收主要是被动转运
C. 弱碱性药物在碱性环境吸收增多
D. 药物吸收指自给药部位进入血液循环的过程
E. 非脂溶性的药物皮肤给药不易吸收

正确答案：A。舌下或直肠给药吸收少，起效慢

解析：本题考查药物的吸收。舌下给药即药物直接通过舌下黏膜吸收，作用迅速；直肠给药为将药物导人直肠内由直肠黏膜血管吸收，吸收较快（A错，为本题正确答案）；药物从胃肠道的吸收主要通过被动转运（B对）；碱性药物在碱性环境中状态多为非解离型，吸收增加（C对）；药物吸收是药物从给药部位进入体循环的过程（D对）；非脂溶性药物由于其脂水分配系数小，不易进入皮肤角质层，不易被皮肤吸收（E对）。